男，47岁，突然神志丧失，呼吸不规则，即刻进行心脏按压，判断其是否有效的主要方法是
A. 测血压
B. 呼喊病人看其是否清醒
C. 摸桡动脉搏动
D. 摸股动脉搏动
E. 观察末梢循环状况

正确答案：D。摸股动脉搏动

解析：胸外按压时，胸腔内压力明显升高并传递到胸内的心脏和血管，再传递到胸腔以外的大血管，驱使血液流动。因此，判断心脏按压是否有效的主要方法为触及大动脉（如股动脉）的搏动（D对）。桡动脉（C错）属于中动脉，搏动恢复较晚，不能及时反应心脏按压的效果。测血压（A错）一般测量的是桡动脉，是判断患者是否存在休克及神经功能障碍的方法。呼喊病人是否清醒（B错）是判断其意识状态的方法。观察末梢循环情况（E错）可判断患者的微循环情况，不能很好的反映心脏复苏有效。